通常单侧上肢深静脉有几条，下列描述错误的是
A. 腋静脉有一条
B. 锁骨下静脉有一条
C. 掌深弓是有二条伴行静脉
D. 尺静脉有一条
E. 桡静脉有二条

正确答案：D。尺静脉有一条

解析：尺静脉为上肢深静脉，与同名动脉伴行，多为两条（D错，为本题正确答案）。